我国人群伤害死亡的首位原因是
A. 自杀
B. 溺水
C. 中毒
D. 非故意跌落
E. 道路交通伤害

正确答案：E。道路交通伤害